提出多水平健康影响因素模型的事
A. 达尔格林
B. 惠特海德
C. 舒尔茨
D. A＋B
E. A＋C

正确答案：D。A＋B

解析：本题考查多水平健康影响因素模型的产生。达尔格林和惠特海德（D对ABCE错）提出了多水平健康影响因素模型，认为人类健康不平等的产生是微观、中观、宏观不同层次健康影响因素和条件共同作用的结果。